上颌侧切牙与上颌中切牙的区别中哪一点是错误的
A. 上颌侧切牙唇面较窄小、圆突
B. 上颌侧切牙舌窝窄而深
C. 上颌侧切牙切缘向远中舌侧的倾斜度较中切牙大
D. 上颌侧切牙近中切角似锐角
E. 上颌侧切牙根长与冠长相近

正确答案：E。上颌侧切牙根长与冠长相近

解析：本题考查牙体解剖外形。上颌侧切牙根长与冠长相近（E错。为本题正确答案）不属于上颌侧切牙与上颌中切牙的区别，上颌侧切牙牙根为单根，根长大于冠长。上颌侧切牙与上颌中切牙的区别有：（1）唇面：与上颌中切牙相似呈梯形，但牙冠较窄小圆突（A对），发育沟不如上颌中切牙明显。近中缘稍长，近中切角似锐角（D对）远中缘较短与切缘弧形相连，远中切角呈圆弧形，因而切缘明显斜向远中。（2）舌面：边缘嵴较上颌中切牙明显，舌窝深而窄（B对）。（3）邻面：略呈三角形，近远中接触区均在切1/3 ，距切角的距离较中切牙稍远。（4）切嵴：向远中舌侧的倾斜度较上颌中切牙大（C对），似与远中面连续。（5）牙根亦为单根，根长大于冠长，较上颌中切牙牙根细且稍长，颈横切面为卵圆形。